某幼儿园发生食物引起的诺如病毒腹泻暴发，该幼儿园共有儿童100人，经调查有50人吃过可疑污染食物，25人发病，因此得出
A. 发病率为50%
B. 患病率为50%
C. 罹患率为50%
D. 罹患率为25%
E. 感染率为25%

正确答案：C。罹患率为50%

解析：本题考查罹患率。罹患率表示某人群某病新病例发生频率，通常多指在某一局限范围，短时间内的发病频率。计算方法＝（观察期内某人群中某病新发病例数÷同期暴露人口数）×K，其中K通常取100%。观察时间可以日、周、旬、月为单位。适用于局部地区疾病的爆发，食物中毒、传染病及职业中毒等爆发流行情况。根据题干内容，可得出罹患率＝（25/50）×100%＝50%（C对ABDE错）。